阿米巴肝脓肿属于
A. 变质性炎症
B. 浆液性炎症
C. 纤维素性炎症
D. 蜂窝织炎症
E. 化脓性炎症

正确答案：A。变质性炎症

解析：阿米巴肝脓肿的脓腔中可见大量肝细胞变性、坏死，而实质细胞明显变性、坏死为变质性炎的特点，故阿米巴肝脓肿属于变质性炎症（A对）。浆液性炎症（B错）常见于渗出性结核性胸膜炎、风湿性关节炎等。纤维素性炎症（C错）常见于大叶性肺炎、白喉的假膜性炎等。化脓性炎症（P76）（E错）可分为表面化脓积脓、脓肿及蜂窝织炎症，其中蜂窝织炎症（D错）常发生于皮肤、肌肉和阑尾。